52岁脑梗死患者，病后第3天，意识不清，血压19/14kPa，左侧偏瘫。颅内压2.74kPa（280mmH₂O），宜首先选用
A. 降血压治疗
B. 扩血管治疗
C. 尿激酶静脉点滴
D. 20%甘露醇静脉点滴
E. 肝素静脉点滴

正确答案：D。20%甘露醇静脉点滴

解析：中年脑梗患者，术后3天，意识不清，血压19/14kPa（143/105mm/Hg）（正常值为90～140/60～90mmHg，血压增高），左侧偏瘫，颅内压280mmH₂O（正常值为70～200mmH₂O，提示颅内压增高），应首先降低颅内压，又因患者意识不清，所以应首先选用20%甘露醇静脉点滴（D对），以维持足够脑灌注和预防脑疝发生。